西医学的急性骨髓炎，相当于中医学的
A. 疔
B. 无头疽
C. 有头疽
D. 附骨疽
E. 流注

正确答案：D。附骨疽

解析：附骨疽是一种毒邪深沉，附骨而生的化脓性疾病，相当于西医的急、慢性化脓性骨髓炎（D对）。疔（A错）包含颜面部疔疮（西医的颜面部疖、痈）、手足部疔疮（西医的手足部急性化脓性感染）、红丝疔（西医的急性淋巴管炎）等。无头疽（B错）是指多次发生于骨骼或关节间等深部组织的化脓性疾病，相当于西医的骨髓炎、骨结核、化脓性关节炎等。中医的有头疽（C错）是发生在肌肤间的急性化脓性疾病，相当于西医的痈。流注（E错）是发于肌肉深部的多发性脓肿，相当于西医脓血症、肌肉深部脓肿和髂窝脓肿。